女，30岁。体检发现胆囊结石2年。近期进食油腻食物后持续上腹痛，向右肩部放射，伴恶心、呕吐，休息后可自行缓解，症状反复发作。查体：上腹明显压痛，Murphy征可疑阳性，肋脊角无压痛、叩痛。为明确诊断，首选的检查方法是
A. MRI
B. 尿常规
C. 腹部B超
D. 血淀粉酶
E. X线钡餐检查

正确答案：C。腹部B超

解析：青年女性，既往胆囊结石病史，近期进食油腻食物后持续上腹痛，向右部放射，伴恶心、呕吐，休息后可自行缓解（胆囊结石的典型表现），症状反复发作，查体：上腹明显压痛，Murphy征可疑阳性，肋脊角无压痛、叩痛（可排除肾结石），根据患者的病史、临床症状及体征，考虑最可能的诊断为胆囊结石，首选的检查方法是腹部超声。MRI（A错）也可显示胆囊结石，但没有B超方便快捷，不是首选检查方法。尿常规（B错）、血淀粉酶（D错）、X线钡餐检查（E错）对胆囊结石的诊断并无意义。